不属于口外片的是
A. 下颌骨后前位片
B. 髁突经咽侧位片
C. 下颌骨开口后前位
D. 下颌横断（牙合）片
E. 下颌骨升支切线位片

正确答案：D。下颌横断（牙合）片

解析：本题考查口外片。不属于口外片的是下颌横断牙合片（D错，为本题正确答案）。下颌横断牙合片属于口内片。